某女，55岁，面色萎黄，唇甲色淡，头晕眼花，脉细。医师辨证后处方为四物合剂。医师处以四物合剂，是因其能主治
A. 气虚证
B. 阴虚证
C. 阳虚证
D. 血虚证
E. 气血两虚证

正确答案：D。血虚证

解析：本题考查的是四物合剂的主治。面色萎黄，唇甲色淡，头晕眼花，脉细。医师辨证后处方为四物合剂。医师处以四物合剂，是因其能主治血虚证（D对）。四物合剂：【主治】血虚所致的面色萎黄、头晕眼花、心悸气短及月经不调。血虚证为养血剂的主治。养血剂主要具有补血作用，主治血虚所致的面色无华、眩晕、心悸失眠、唇甲色淡，或妇女月经不调、经少色淡，甚或闭经等。气虚证（A错）为补气剂的主治。补气剂主要具有补益脾肺之气作用，主治脾气虚所致的倦怠乏力、食少便溏、以及肺气虚所致的少气懒言、语声低微、动则气喘等。阴虚证（B错）为滋阴剂的主治。滋阴剂主要具有滋补肝肾、益精填髓作用，主治肝肾阴虚所致的形体消瘦、头晕耳鸣、腰膝酸软、口燥咽干、五心烦热、盗汗遗精、骨蒸潮热，以及阴虚劳嗽、干燥咯血等。阳虚证（C错）为补阳剂的主治。助阳剂主要具有温补肾阳作用，主治肾阳不足所致的形寒肢冷、气怯神疲、腰酸腿软、少腹拘急、小便不利或小便频数、男子阳痿早泄、女子宫寒不孕等。气血两虚证（E错）为补气养血剂的主治。补气养血剂主要具有补益气血作用，主治气血两虚所致的面色无华、头晕目眩、心悸气短、语声低微等。